不直接参加构成大脑动脉环的是
A. 大脑前动脉起始段
B. 颈内动脉末端
C. 大脑后动脉
D. 锁骨下动脉
E. 无

正确答案：D。锁骨下动脉

解析：大脑动脉环(Willis环）使两侧颈内动脉系与椎－基底动脉系相交通，它是由大脑前动脉起始段（A对）、两侧颈内动脉末段（B对）、两侧大脑后动脉（C对）共同构成（D错，为本题正确答案）。